某男，60岁，20年前患风湿性关节炎，10年前又患高血压病，刻下痹痛筋脉拘麻，时见头晕头胀，血压160/90mmHg。病证属风湿痹痛兼高血压，沿先用的药组是
A. 白鲜皮配豨莶草
B. 豨莶草配臭梧桐
C. 豨签草配徐长卿
D. 海风藤配臭捂桐
E. 白鲜皮配臭梧桐

正确答案：B。豨莶草配臭梧桐

解析：本题考查的是豨莶草的配伍。病证属风湿痹痛兼高血压，沿先用的药组是豨莶草配臭梧桐（B对）。豨莶草：【配伍】豨莶草配臭梧桐：豨莶草性寒，功能祛风湿、通经络、降血压；臭梧桐性凉，功能祛风、除湿、活络、降血压。两药相配，既祛风湿、通经络，治风湿痹痛筋脉拘麻；又降血压，治高血压病。若为风湿痹痛肢麻兼高血压者用之最宜。白鲜皮配豨莶草（A错）、豨签草配徐长卿（C错）、海风藤配臭捂桐（D错）与白鲜皮配臭梧桐（E错）的配伍，2022年考试指南未明确说明。